心经的原穴是
A. 神门
B. 间使
C. 大陵
D. 内关
E. 太渊

正确答案：A。神门

解析：神门为手少阴心经的原穴（A对）。间使为手厥阴心包经经穴（B错）。大陵为手厥阴心包经输穴、原穴（C错）。内关为手厥阴心包经络穴、八脉交会穴（通于阴维脉）（D错）。太渊为手太阴肺经输穴、原穴（E错）。记忆：所有原穴，四老太太冲进大门求养三骨。太渊，太白，太冲，太白，太溪，冲阳，大陵，神门，丘墟，阳池，合谷，京骨，腕骨。